在运输中应冷库贮存并避免冻结同时避免振荡的药品是
A. 促甲状腺素
B. 绒促性素
C. 破伤风人免疫球蛋白
D. 结合雌激素
E. 重组人促红素

正确答案：E。重组人促红素

解析：本题考查药品的贮存。在运输中应冷库贮存并避免冻结同时避免振荡的药品是重组人促红素（E对）。不同的配方和储存条件变化（搬运时震动）可能会改变人促红细胞生成素二级结构，出现纯红细胞再生障碍性贫血（PRCA）。促甲状腺激素（A错）的贮存：遮光，密封，在冷处保存。绒促性素（B错）的贮存：遮光，密封，在冷处保存。破伤风免疫球蛋白（C错）在运输过程中应采用最快速的运输方法，缩短运输时间；应用冷链运输，注意防止制品冻结。结合雌激素（D错）注射液：一般情况下，配好溶液在数小时内用完。如有必要，可将溶液放置于15～30°C（59～86°F）室温下，避光保存。